下列特定穴中，治疗急性病症应首先选用
A. 原穴
B. 俞穴
C. 八会穴
D. 八脉交会穴
E. 郄穴

正确答案：E。郄穴

解析：治疗急性病症首选郄穴(E对)。原穴主要用于治疗相关脏腑的疾病(A错)。俞穴是脏腑之气输注于背腰部的腧穴，与脏腑有密切关系(B错)。八会穴除治疗所在经脉的病症外，还具有其特殊的治疗效果，此外八会穴还可治疗相关的热病(C错)。交会穴主要治疗交会经脉的疾病(D错)。